提示心房扑动的心电图是
A. 心室率不规整
B. 出现f波
C. PR间期逐渐延长，QRS波周期性脱落
D. 刺激迷走神经后心室率明显加快伴心律不齐
E. 出现F波

正确答案：E。出现F波

解析：心房扑动【心电图检查】心电图特征为：①心房活动呈现规律的锯齿状扑动波称为F波（E对），扑动波之间的等电线消失，在II、III、aVF或V₁导联最为明显。典型房扑频率常为250-300次/分。②心室率规则或不规则，取决于房室传导比例是否恒定。当心房率为300次/分，未经药物治疗时，心室率通常为150次/分（2：1房室传导）。③QRS波形态正常，当出现室内差异传导、原先有束支传导阻滞或经房室旁路下传时，QRS波增宽、形态异常（图3-3-12）。f波为心房颤动的心电图表现（B错）。二度I型房室传导阻滞这是最常见的二度房室阻滞类型，表现为：①PR间期进行性延长、直至一个P波受阻不能下传心室（C错）；②相邻RR间期进行性缩短，直至一个P波不能下传心室；③包含受阻P波在内的RR间期小于正常窦性PP间期的两倍。